患儿，男性，3个月。体重6kg。生命体征平稳，心肺未见异常，血尿常规检查未见异常。其左侧上唇连同鼻底裂开，右侧上唇部分裂开，鼻底尚完整。在术前检查中，影响手术的内容不包括
A. 上呼吸道感染
B. 听力障碍
C. 先天性心脏病
D. 面部湿疹
E. 不明原因的发热

正确答案：B。听力障碍

解析：本题考查唇腭裂的序列治疗。患者左侧Ⅲ度右侧Ⅱ度唇裂，在术前检查中，影响手术的内容不包括听力障碍（B错，为本题正确答案）。 A、C、E较易于理解，面部湿疹（D对）属于面部皮肤病之一，有可能累及白唇皮肤并影响伤口愈合。